男，67岁。反复咳嗽、咳痰30年，加重1周。查体：双肺可闻及干湿性啰音。动脉血气分析示：pH7.21，PaO₂75mmHg，PCO₂50mmHg，碳酸氢根19.6mmol/L。酸碱平衡失调的类型是
A. 代谢性碱中毒
B. 代谢性酸中毒
C. 呼吸性酸中毒合并代谢性酸中毒
D. 呼吸性酸中毒
E. 呼吸性酸中毒合并代谢性碱中毒

正确答案：C。呼吸性酸中毒合并代谢性酸中毒

解析：老年男性患者，反复咳嗽、咳痰30年（慢性阻塞性肺疾病常见症状），加重一周。查体双肺可闻及干湿性啰音（慢阻肺急性发作常见体征），根据动脉血气分析显示：pH7.21（＜7.35为酸中毒），PaO₂75mmHg（正常值为100mmHg，提示患者缺氧），PaCO₂50mmHg（＞45mmHg为呼吸性酸中毒），碳酸氢根19.6mmol/L（＜22mmol/L为代谢性酸中毒），因此该患者最有可能的诊断为慢性阻塞性肺疾病急性发作，引起患者缺氧及二氧化碳潴留，导致呼吸性酸中毒合并代谢性酸中毒（C对BD错）。代谢性碱中毒患者实际碳酸氢盐AB＞26mmol/L，本例患者碳酸氢根减小，因此排除代谢性碱中毒（AE错）。